男，68岁。阵发性腹痛1年，自觉有“气块”在腹中窜动，起初大便次数增加，近3个月腹胀、便秘，近3天无肛门排气、排便，呕吐物有粪便臭味，一直感乏力和低热。根据病史考虑肠梗阻应为
A. 高位完全梗阻
B. 低位不完全梗阻
C. 血运性肠梗阻
D. 高位不完全梗阻
E. 低位完全梗阻

正确答案：E。低位完全梗阻

解析：老年男性患者，阵发性腹痛1年，腹胀、便秘3个月，近3天无肛门排气、排便（提示完全性肠梗阻），呕吐物有粪便臭味（提示低位肠梗阻），应考虑为低位完全性肠梗阻（E对）。低位完全性梗阻腹胀明显，呕吐出现较晚，早期为胃内容物，晚期可吐粪样物，完全停止排便排气。高位梗阻（AD错）时呕吐出现早，呕吐频繁，呕吐物主要为胃及十二指肠内容物。血运性肠梗阻（C错）早期表现为突发剧烈的腹部绞痛，恶心呕吐频繁，呕吐物为血性，腹部体征轻微，与严重的症状不相称。低位不完全梗阻（B错）呕吐与腹胀均较轻，可有自肛门排便排气。